胆总管
A. 由肝左、右管汇合成
B. 位于肝胃韧带内
C. 位于肝门静脉后方
D. 经十二指肠降部前方
E. 与胰管汇合成肝胰壶腹

正确答案：E。与胰管汇合成肝胰壶腹

解析：胆总管由肝总管和胆囊管汇合而成(A错)，位于肝十二指肠韧带内(B错)，位于肝门静脉前方(C错)，经十二指肠降部后方(D错)，与胰管汇合形成肝胰壶腹(E对)。